小隐静脉
A. 经内踝后方
B. 经外踝前方
C. 沿小腿前面上行
D. 在足的外侧缘起自足背静脉弓
E. 注入股静脉

正确答案：D。在足的外侧缘起自足背静脉弓

解析：小隐静脉经外踝后方（AB错）。沿小腿后面（C错）上行。在足的外侧缘起自足背静脉弓（D对）。注入腘静脉（E错）。